胃食管反流病的主要发病机制不包括
A. 夜间胃酸分泌过多
B. 食管下括约肌压力降低
C. 异常的食管下括约肌一过性松弛
D. 胃排空异常
E. 食管清除作用降低

正确答案：A。夜间胃酸分泌过多

解析：夜间胃酸分泌过多不是胃食管反流病的发病机制，是十二指肠球部溃疡的主要发病机制（A错，为本题正确答案）。食管下括约肌在食管胃连接处形成的高压带，是抗反流屏障的主要组成部分，因此食管下括约肌压力降低（B对）或者异常的食管下括约肌一过性松弛（C对），都是胃食管反流病的主要发病机制。胃排空异常（D对）导致胃内高压，使其与下食管括约肌形成的高压带之间的压力差减小，是胃食管反流病的主要发病机制之一。正常情况下食管蠕动可将反流的胃酸排入胃内，因此食管清除作用降低（E对）也是胃食管反流病的主要发病机制。